以下辅料中，属于阴离子型表面活性剂的是
A. 司盘20
B. 十二烷基苯磺酸钠
C. 苯扎溴铵
D. 卵磷脂
E. 吐温80

正确答案：B。十二烷基苯磺酸钠

解析：本题考查表面活性剂。十二烷基苯磺酸钠（B对）为阴离子表面活性剂。司盘20（A错）即脱水山梨醇月桂酸酯，是非离子表面活性剂。苯扎溴铵（C错）为阳离子表面活性剂。卵磷脂（D错）为两性离子表面活性剂。吐温80（E错）为非离子表面活性剂。